具有利尿通淋功效的药物是
A. 川芎
B. 丹参
C. 郁金
D. 桃仁
E. 牛膝

正确答案：E。牛膝

解析：该题考查牛膝的功效。牛膝味苦、甘、酸，性平，归肝、肾经，其功效为活血通经，补肝肾，强筋骨，利水通淋，引火（血）下行（E对）。